动力作业时肌肉的主要收缩方式是
A. 等张收缩
B. 等长收缩
C. 等力收缩
D. 间断性收缩
E. 持续性收缩

正确答案：A。等张收缩